维生素B₂缺乏时，可以出现的缺乏症有
A. 毛囊角化
B. 脂溢性皮炎
C. 皮下出血
D. 皮疹
E. 对称性皮炎

正确答案：B。脂溢性皮炎